下列药物中，易受光线影响而变质，需要遮光保存的药物有
A. 肾上腺素
B. 维生素K₁
C. 碳酸钙
D. 维生素B₁₂
E. 甲钴胺

正确答案：A、B、D、E。肾上腺素；维生素K₁；维生素B₁₂；甲钴胺

解析：本题考查药品的贮存。易受光线影响而变质，需要遮光保存的药品有维生素K₁（B对）、维生素B₁₂（D对）、甲钴胺制剂（E对）、肾上腺素注射剂（A对）。碳酸钙（C错）是易受湿度影响的药物，不能受潮，需干燥保存。